PQLI是评价人口素质的重要指标之一，其含义是
A. 生活变化单位
B. 生命质量指数
C. 质量调整生活年
D. 健康相关生命质量
E. 期望寿命指数

正确答案：B。生命质量指数

解析：本题考查PQLI的含义。PQLI即物质生活质量指数（B对ACDE错），是衡量一个国家或地区居民的营养、卫生保健和教育水平的综合指标，突出强调了卫生与教育质量在社会经济发展中的作用，弥补了仅用国内生产总值指标的不足。PQLI大于80为高素质人口，PQLI小于60为低素质人口。